长期使用具有依赖性的药物，停药会出现
A. 戒断症状
B. 后遗效应
C. 特异质反应
D. 停药反应
E. 继发反应

正确答案：D。停药反应